纤维性心包
A. 分壁层和脏层
B. 下方与膈胸膜相贴
C. 与出入心的大血管外膜相续
D. 与心外膜之间的窄隙称心包腔
E. 伸缩性较大

正确答案：C。与出入心的大血管外膜相续

解析：分壁层和脏层（A错）为浆膜心包。纤维性心包下方与膈的中心腱（B错）愈着。与出入心的大血管外膜相续（C对）。浆膜心包脏、壁两层（D错）之间的潜在性腔隙称心包腔。